石棉肺患者的肺功能降低与肺活量表现的关系是
A. 往往出现的晚
B. 往往出现的早
C. 无关
D. 同步出现
E. 相反

正确答案：B。往往出现的早

解析：本题考查肺功能和肺活量的关系。石棉肺病人早期的肺功能损害下降早于肺活量（B对ACDE错）。